某男，56岁，患高血压病服用吲达帕胺，后因血压控制不理想，自行加服珍菊降压片。近期感觉胸闷、心悸、乏力。到医院就诊。医师告知患者联合用药一定要了解药物的成分和作用。珍菊降压片是含有西药成分的中成药，所含降压药成分是
A. 甲基多巴
B. 利血平
C. 盐酸可乐定
D. 硝普钠
E. 氯沙坦

正确答案：C。盐酸可乐定

解析：本题考查的是含西药组分的中成药。珍菊降压片是含有西药成分的中成药，所含降压药成分是盐酸可乐定（C对）。珍菊降压片：功能降压。用于高血压。含西药成分盐酸可乐定、氢氯噻嗪。甲基多巴（A错）、利血平（B错）为抗高血压药。含硝普钠（D错）、氯沙坦（E错）的中成药，2022年考试指南未明确说明。